矽肺胸片中，不规则小阴影的病理基础是
A. 小结节
B. 间质纤维化
C. 团块状纤维化
D. 大结节

正确答案：B。间质纤维化

解析：本题考查不规则小阴影的概念。不规则形小阴影多为接触游离SiO₂含量较低的粉尘所致，病理基础主要是肺间质纤维化（B对ACD错）。按其宽度可分为s（＜1.5㎜）、t（1.5～3.0㎜）、u（3.0～10㎜）三种类型。